不属于包合物制备方法的是
A. 浓融法
B. 饱和水溶液法
C. 研磨法
D. 冷冻干燥法
E. 喷雾干燥法

正确答案：A。浓融法

解析：本题考查包合物的制备方法。不属于包合物制备方法的是浓融法（A错，为本题正确答案）。包合物是指一种药物分子被全部或部分包入另一种物质的分子腔中而形成的独特形式的络合物。其主要制备方法有饱和水溶液法（B对）、研磨法（C对）、冷冻干燥法（D对）和喷雾干燥法（E对）等。